修复后发生龈缘炎首先最佳的处理方法是
A. 观察
B. 拆除重做
C. 局部消除炎症
D. 修改修复体的悬突
E. 利用邻牙充填治疗

正确答案：C。局部消除炎症

解析：处理方法：可局部用消炎镇痛药消除炎症，尽可能消除或减少致病因素，保守治疗后若症状不缓解，应拆除修复体重做。掌握“修复体戴入后的问题及处理”知识点。